乳牙在口内存在的时间最短者为
A. 6个月
B. 2年
C. 5～6年
D. 10年
E. 13～14年

正确答案：C。5～6年

解析：本题考查乳牙在口腔内存在的时间。乳牙在口内存在的时间最短者为5～6年（C对）。乳牙在口腔内的时间，最短者5～6年（6个月到2.5岁：乳牙萌出顺序为12435，下1先长先掉，6个月到六岁，所以五到六年），长者可达10年左右。虽然乳牙在口腔内存在时间较短，但此时正值儿童生长发育的快速期，因此，保护乳牙对于保障消化和促进营养的吸收，刺激颌面部正常生长发育，引导恒牙正常萌出，都极为重要。